流行性出血热临床三大主征是
A. 发热、出血、肾损害
B. 发热、出血、休克
C. 发热、充血、休克
D. 发热、休克、尿蛋白
E. 发热、水肿、低血压

正确答案：A。发热、出血、肾损害